弱视是常见的儿童眼病，下列关于弱视的说法，错误的是
A. 无明显的眼部器质性改变，主要由功能性因素引起远视力低于0.8
B. 弱视通过屈光矫正可以达到正常或较好视力
C. 弱视仅发生在发育未成熟的小儿，8岁以上的儿童视觉发育成熟，不会发生弱视
D. 弱视儿童不能形成完整的立体视觉，严重者可引起立体盲等视功能障碍
E. 目前，对弱视没有有效的治疗方法

正确答案：E。目前，对弱视没有有效的治疗方法